在非快速眼动期（NREM）睡眠的第3～4期突然出现惊叫哭喊，伴有惊恐表情和动作，同时有定向力障碍，历时10多分钟。清醒后对夜间发作不能回忆。可诊断为
A. 失眠症
B. 睡行症
C. 睡眠呼吸暂停综合征
D. 夜惊
E. 梦魇

正确答案：D。夜惊

解析：该患者在非快速眼动期（NREM）睡眠，突然出现惊叫哭喊（表现为从睡眠中突然醒来并惊叫），伴有惊恐表情和动作，同时有定向力障碍，历时10多分钟（发作持续时间约十分钟），清醒后对夜间发作不能回忆为夜惊（D对）。睡行症（梦游症）的患者表现为睡眠过程尚未清醒时起床在室内或户外行走，或做一些简单活动的睡眠和清醒的混合状态，与本例不符（B错）。梦魇发生于快眼（REM）睡眠阶段，醒后能清晰回忆梦境恐怖内容，与本例不符（E错）。